肺组织切片检查，光镜下见细支气管上皮脱落，腔内及周围肺泡腔内亦有多少不等的脓性渗出物，应诊断为
A. 慢性肺淤血
B. 大叶性肺炎灰色肝变期
C. 小叶性肺炎
D. 大叶性肺炎溶解消散期
E. 肺结核变质渗出期

正确答案：C。小叶性肺炎

解析：肺组织切片检查，光镜下见细支气管上皮脱落，腔内及周围肺泡腔内亦有多少不等的脓性渗出物，应诊断为小叶性肺炎（C对）。慢性肺淤血（P46）（A错）镜下可见特征性心衰细胞。大叶性肺炎的自然发展过程可分为充血水肿期、红色肝变期、灰色肝变期和溶解消散期，其中灰色肝变期（P164）镜下可见肺泡腔内渗出的是纤维素和中性粒细胞（B错），溶解消散期（P165）肺泡腔内主要见纤维素溶解（D错）。肺结核（P351）变质渗出期主要表现为浆液性或浆液纤维素性炎，肺泡腔内渗出的不会是脓性物（E错）。